直接抑制DNA合成的蒽醌类
A. 喜树碱
B. 硫酸长春碱
C. 多柔比星
D. 紫杉醇
E. 盐酸阿糖胞苷

正确答案：C。多柔比星

解析：本题考查多柔比星。多柔比星（C对）是直接抑制DNA合成的蒽醌药物。喜树碱（A错）是直接破坏DNA结构与DNA结合而使DNA易受内切酶的攻击，同时抑制DNA聚合酶而影响DNA的复制；硫酸长春碱（B错）为有丝分裂抑制剂；紫杉醇（D错）能够抑制微管解聚化；盐酸阿糖胞苷（E错）属于抗代谢药物,主要作用于DNA聚合酶,从而达到细胞毒作用。